中西药合理联用的优点有
A. 提高疗效
B. 缩短疗程
C. 促进体质恢复
D. 降低化学药物的用量
E. 降低化学药物的毒副反应

正确答案：A、B、C、D、E。提高疗效；缩短疗程；促进体质恢复；降低化学药物的用量；降低化学药物的毒副反应